根据《麻醉药品和精神药品管理条例》，麻醉药品和第一类精神药品的区域性批发企业
A. 应当经国家药品监督管理局批准
B. 可以自行向邻省的医疗机构供应第一类精神药品以便满足边远地区的需求
C. 应当经所在地卫生行政部门批准，向本省内销售第一类精神药品
D. 可以向科研单位提供麻醉药品和第一类精神药品小包装原料药
E. 应当在申请认定资格前，2年内没有违反有关禁毒的法律、行政法规规定的行为

正确答案：E。应当在申请认定资格前，2年内没有违反有关禁毒的法律、行政法规规定的行为

解析：本题考察特殊药品管理。麻醉药品和第一类精神药品的区域性批发企业应当在申请认定资格前，2年内没有违反有关禁毒的法律、行政法规规定的行为（E对）。